不影响结婚或生育的疾病是
A. 严重遗传性疾病
B. 梅毒急性感染期
C. 淋病
D. 精神分裂症发病期间
E. 神经衰弱

正确答案：E。神经衰弱

解析：本题考查影响结婚或生育的疾病。神经衰弱（E错，为本题正确答案）属于不影响结婚或生育的疾病。梅毒急性感染期（B对）、淋病（C对）属于认为影响结婚和生育的婚前医学检查的指定传染病。严重遗传性疾病（A对）医学上认为不宜生育。精神分裂症发病期间（D对）医学上认为应暂缓结婚的疾病。